经济水平的提高对健康影响
A. 既有利，亦有弊
B. 有利，无弊
C. 有弊，无利
D. 无影响
E. 以上都不对

正确答案：A。既有利，亦有弊

解析：本题考查经济水平的提高对健康影响。经济发展水平的提高对健康影响既有利，亦有弊（A对BCDE错）。经济发展能提高人类健康水平，在某种程度上决定着健康水平。但是，如果经济发展缺乏可持续发展的观念，不注重生态环境保护，就会带来诸多新的健康问题，反过来损害人群健康。